女，65岁。常规体检发现脾左肋下5cm，化验：Hb135g/L，WBC117×l0⁹/L分类中幼粒5%，晚幼粒12%，杆状核22%，分叶中性粒34%，嗜酸粒5%，嗜碱粒14%，淋巴细胞14%。Plt560×10⁹/L，NAP（-）。为确定诊断，首选的检査是
A. 腹部CT
B. 腹部B超
C. 肝功能
D. 血免疫球蛋白
E. 骨髓检查

正确答案：E。骨髓检查

解析：患者老年女性，脾左肋下5cm（脾肿大为慢性粒细胞白血病最显著的体征），化验：Hb135g/L（成年女性Hb正常110～150g/L）正常，WBC117×10⁹/L（正常4～10×10⁹/L）（慢性粒细胞白血病白细胞常明显增多，可达100×l0⁹/L）。分类中幼粒5%，晚幼粒12%，杆状核22%（正常0%～5%），分叶中性粒34%（正常50%～70%），嗜酸粒5%（正常0.5%～5%），嗜碱粒14%（正常0%～1%），淋巴细胞14%（正常20%～40%）（分类可见各阶段粒细胞，嗜酸性、嗜碱性粒细胞增多，符合慢粒特点），Plt560×l0⁹/L（正常100～300×10⁹/L）增多，NAP（-）（急、慢性粒细胞白血病时中性粒细胞成熟障碍，中性粒细胞碱性磷酸酶阴性），故患者诊断为慢性粒细胞白血病的可能性大，应首选骨髓检查（E对）予以明确诊断。腹部CT（A错）、腹部B超（B错）为影像学检查方法，主要用于腹腔脏器检查；肝功能（C错）主要用于肝脏疾病的诊断；血免疫球蛋白（D错）主要用于免疫性疾病的诊断。